在社区获得性肺炎的经验治疗中，重症患者可选用的抗菌药物联合治疗方案有
A. 头孢曲松+阿奇霉素
B. 左氧氟沙星+阿奇霉素
C. 头孢哌酮舒巴坦+克拉霉素
D. 头孢他啶+甲硝唑
E. 万古霉素+美罗培南

正确答案：A、B、C。头孢曲松+阿奇霉素；左氧氟沙星+阿奇霉素；头孢哌酮舒巴坦+克拉霉素

解析：本题考查肺炎治疗药。在社区获得性肺炎的经验治疗中，重症患者可选用的抗菌药物联合治疗方案有头孢曲松+阿奇霉素（A对）；左氧氟沙星+阿奇霉素（B对）；头孢哌酮舒巴坦+克拉霉素（C对）。头孢曲松、头孢他啶、头孢哌酮舒巴坦均为β-内酰胺类抗菌药；阿奇霉素和克拉霉素为大环内酯类抗生素；左氧氟沙星为喹诺酮类抗菌药。β-内酰胺类联合大环内酯类或氟喹诺酮类可用于治疗社区获得性肺炎重症患者。甲硝唑（D错）主要用于治疗或预防厌氧菌引起的系统或局部感染，如腹腔、消化道、女性生殖系、下呼吸道、皮肤及软组织、骨和关节等部位的厌氧菌感染，不用于治疗社区获得性肺炎。万古霉素在其他抗菌药物使用无效时使用，是最后一线药物；美罗培南为碳青霉烯类抗生素，用于院内获得性肺炎（E错）。